我国食品安全法律法规体系中法律效力最高的是
A. 《中华人民共和国食品安全法》
B. 《国务院关于加强食品等产品安全监督管理的特别规定》
C. 《保健食品注册与备案管理办法》
D. 《北京市食品安全条例》
E. 《重庆市食品安全管理办法》

正确答案：A。《中华人民共和国食品安全法》

解析：本题考查我国食品安全法律法规体系中法律效力最高的法律。我国食品安全法律法规体系中法律效力最高的是《中华人民共和国食品安全法》（A对BCDE错）。